关于肿瘤的治疗哪项不正确
A. 良性肿瘤一般以外科治疗为主
B. 细胞分化程度较好的恶性肿瘤常采用手术治疗
C. 位于颌面深部或近颅底的肿瘤，首先考虑放疗或化疗
D. 临床上对于骨肉瘤或者恶性黑色素瘤可以进行放射治疗
E. 颌骨肿瘤一般以手术治疗为主

正确答案：D。临床上对于骨肉瘤或者恶性黑色素瘤可以进行放射治疗

解析：骨肉瘤、恶性黑色素瘤在临床上对于射线相对不敏感。所以此两种肿瘤应用放射治疗效果不明显。掌握“口腔颌面部肿瘤的治疗原则及预防”知识点。